舌杆上缘距余留牙舌侧龈缘的距离应不小于
A. 15mm
B. 0.5mm
C. 1.0mm
D. 3.0mm
E. 2.0mm

正确答案：D。3.0mm

解析：本题考查舌杆。舌杆上缘距余留牙舌侧龈缘的距离应不小于3.0mm（D对）。舌杆位于下颌舌侧龈缘与舌系带、黏膜皱褶之间，距龈缘3～4mm。